具有推动心脏搏动的气是
A. 卫气
B. 中气
C. 元气
D. 宗气
E. 营气

正确答案：D。宗气

解析：推动心脏搏动实质是心脏推动血液运行，宗气生成之后一方面可贯注于心脉之中，促进心脏推动血液运行，即可推动心脏搏动（D对）。营气的生理功能有化生血液和营养全身（E错）。卫气的生理功能有防御外邪、温养全身和调控腠理（A错）。元气的生理功能有推动和调节人体的生长发育和生殖机能、推动和调控各脏腑、经络、形体、官窍的生理活动（C错）。